如已确诊为成釉细胞瘤，肿瘤较大，为防止复发，其治疗原则为
A. 放射治疗
B. 手术彻底刮除肿瘤
C. 切除整个下颌骨
D. 下颌骨节段性切除
E. 化学药物治疗

正确答案：D。下颌骨节段性切除

解析：对较小的肿瘤可行下颌骨方块切除，以保存下颌骨的连续性；对较大的肿瘤应将病变的颌骨节段性切除，以保证手术后不再复发。掌握“成釉细胞瘤”知识点。